引起菌群失调症的主要表现是
A. 正常菌群的遗传性特征发生改变
B. 正常菌群的耐药性发生明显改变
C. 正常菌群的组成和数量明显改变
D. 正常菌群的增殖方式发生明显改变
E. 大量使用生物制剂

正确答案：C。正常菌群的组成和数量明显改变

解析：菌群失调指寄生在正常人体某部位的正常菌群，各菌种之间的比例发生了较大幅度的超出正常范围的改变，多由滥用广谱抗生素引起。由于菌群失调引起的疾病，称为菌群失调症。掌握“细菌的分类”知识点。